下列中毒性细菌性痢疾的治疗措施，错误的是
A. 抗菌治疗
B. 扩充血容量
C. 纠正代谢性酸中毒
D. 血管活性药物的应用
E. 纠正代谢性碱中毒

正确答案：E。纠正代谢性碱中毒

解析：中毒性菌痢应采取综合急救措施，力争早期治疗。治疗措施包括病原治疗和对症治疗。病原治疗，应用有效抗菌药物静脉滴注（A对）。对症治疗，重点是针对休克的相关治疗，包括迅速扩充血容量（B对）、纠正代谢性酸中毒（C对）、使用血管活性药物（D对）改善微循环障碍和保护重要脏器等。中毒性细菌性痢疾主要发生的酸碱失衡为代谢性酸中毒，而无代谢性碱中毒，故无需纠正代谢性碱中毒（E错，为本题正确答案）。